最早指出黄疸有传染性的中医文献是
A. 《黄帝内经》
B. 《伤寒论》
C. 《金匮要略》
D. 《丹溪心法》
E. 《沈氏尊生书》

正确答案：E。《沈氏尊生书》

解析：清代沈金鳌《沈氏尊生书·黄疸》有“天行疫疠，以致发黄者，俗称之瘟黄，杀人最急”的记载，指出了黄疸具有传染性（E对）。春秋战国时期即有关于黄疸病名和主要症状的记载。如《素问·平人气象论》云：“溺黄赤，安卧者，黄疸…目黄者曰黄疸。”《灵枢·论疾诊尺》云：“身痛面色微黄，齿垢黄，爪甲上黄，黄疸也。”（A错）。东汉时期，张仲景《金匮要略·黄疸病脉证并治》始有黄疸的分类，将黄疸分为黄疸、谷疸、酒疸、女劳疸、黑疸五种（C错）。